左心衰竭病人出现右心衰竭时，表现出：
A. 肺淤血继续存在
B. 肺水肿继续存在
C. 肺淤血减轻
D. 肺淤血合并体循环淤血
E. 肺循环和体循环都恢复正常

正确答案：C。肺淤血减轻

解析：左心衰竭时，左心室收缩期输出量减少，引起舒张期充盈压升高，肺循环回流阻力增加，久之导致肺循环淤血。而肺循环阻力增加又可加重右心室后负荷，久之可导致右心衰竭，此时因右心衰引起右心室输出量减少，肺淤血减轻（C对）。理论上说全心衰竭时肺循环、体循环回流阻力增加可导致机体出现肺循环淤血合并体循环淤血，但肺淤血减轻是左心衰病人出现右心衰时更具特征性的改变，因而本题最佳答案选C。